下列情况可以行乳腺癌保乳手术的是
A. 不同象限的多个病灶
B. 患侧乳腺内有弥漫钙化灶
C. 合并有硬皮病的患者
D. 外上象限直径2cm肿瘤
E. 曾接受过胸部放疗的患者

正确答案：D。外上象限直径2cm肿瘤

解析：根据乳腺癌分期，“不同象限的多个病灶（A错）”或“患乳腺内有弥漫钙化灶（B错）”，即存在多个病灶者，如无远处转移则为Ⅲ期，如有远处转移则为Ⅳ期，均不满足保乳手术适应症。硬皮病为胶原血管性疾病，患者手术后易引起严重的软组织纤维化，故不宜手术（C错）。“外上象限直径2cm肿瘤”，如无同侧腋窝淋巴结肿大或有同侧腋窝肿大淋巴结，尚可推动，则为Ⅰ期或Ⅱ期，可手术（D对）。胸壁曾接受过大剂量放疗者为保乳手术禁忌症（E错）。